瘦体重不包括
A. 神经血管
B. 内脏器官
C. 皮肤和皮下组织
D. 骨骼系统
E. 肌肉

正确答案：C。皮肤和皮下组织

解析：本题考查体重的相关内容。瘦体重亦称“去脂体重”，由身体细胞重量、细胞外水分和去脂的固体部分组成，不包括皮肤和皮下组织（C错，为本题正确答案）。瘦体重的主要成分是骨骼（D对）、肌肉（E对）、器官（B对）、胶质细胞（A对）等。